变异杆卡不包括
A. T形卡环
B. U形卡环
C. L形卡环
D. I形卡环
E. C形卡环

正确答案：D。I形卡环

解析：本题考查杆形卡环。杆形卡环可根据基牙的外形、倒凹位置和大小，设计成不同形状，例如I型、T型、L型、U型及C型等，其中I型卡环（D错，为本题的正确答案）为最初设计的杆卡，T型（A对）、U型（B对）、L型（C对）及C型（E对）为根据不同情况所设计出的杆卡的变异型。